男孩，3岁，自幼人工喂养，食欲极差，有时腹泻。身高85cm，体重7500g。皮肤干燥苍白，腹部皮下脂肪厚度约0.3cm。脉搏缓慢，心音较低钝。假设此患儿出现哭而少泪，眼球结膜有毕脱斑，则有
A. 维生素A缺乏
B. 维生素B缺乏
C. 维生素C缺乏
D. 维生素D缺乏
E. 维生素E缺乏

正确答案：A。维生素A缺乏

解析：维生素A缺乏（A对）临床上最主要表现为干燥症，特别是眼球结膜出现毕脱斑，皮肤干燥瘙痒，易脱屑。严重缺乏时会表现出生长发育障碍（身高落后，易龋齿）以及贫血。维生素B1缺乏（B错）无毕脱斑，主要表现为口角炎、皮炎和脚气病等。维生素C缺乏（C错）主要表现为坏血病（第七版诸福棠实用儿科学P532）表现诸如低热、肢体肿痛、假性瘫痪、皮下出血等症状。维生素D缺乏（D错）主要表现为佝偻病（P77）骨骼的临床表现，譬如颅骨软化、“方盒样”头型、“鸡胸样”畸形等。维生素E缺乏（E错）病（第七版诸福棠实用儿科学P548）主要表现为水肿、贫血和幼儿的认知能力和运动发育不良。